用于治疗结核病的药物是
A. 氯霉素
B. 青霉素
C. 替莫西林
D. 四环素
E. 利福平

正确答案：E。利福平

解析：本题考查利福平。用于治疗结核病的药物是利福平（E对）。利福平为利福霉素类半合成广谱抗菌药，对结核分枝杆菌和部分非结核分枝杆菌（包括麻风分枝杆菌等）在宿主细胞内外均有明显的杀菌作用；对需氧革兰阳性菌具良好抗菌作用，包括葡萄球菌产酶株及甲氧西林耐药株、肺炎链球菌。氯霉素（A错）是一种具有旋光活性的酰胺醇类抗生素，为敏感菌株所致伤寒、副伤寒的首选药物。由沙门菌属感染的胃肠炎一般不宜应用本品，如病情严重，有合并败血症可能时仍可选用。青霉素（B错）是抗菌素的一种，是指分子中含有青霉烷，能破坏细菌的细胞壁并在细菌细胞的繁殖期起杀菌作用的一类抗生素。适用于溶血性链球菌、肺炎链球菌、对青霉素敏感（不产青霉素酶）金葡菌等革兰阳性球菌所致的感染以及破伤风、气性坏疽、流行性脑脊髓膜炎、鼠咬热、梅毒、淋病。替莫西林（C错）为耐β-内酰胺酶的半合成青霉素。对革兰阴性菌有高度抗菌活性，对β-内酰胺酶高度稳定，某些第三代头孢菌素耐药的革兰阴性菌应用本品有效。对肠杆菌属细菌、溶血性链球菌等抗菌活性好；但对绿脓杆菌活性差。四环素（D错）高浓度时具杀菌作用，除了常见的革兰氏阳性菌、革兰氏阴性菌以及厌氧菌外，多数立克次体属、支原体属、衣原体属、非典型分枝杆菌属、螺旋体也对该品敏感。